自然灾害发生后，判断水质是否达到流行病学上安全的重要指标是
A. 细菌总数和痢疾杆菌
B. 痢疾杆菌和总大肠菌群
C. 伤寒、副伤寒杆菌总数
D. 总大肠菌群和菌落总数
E. 总大肠菌群和伤寒杆菌

正确答案：D。总大肠菌群和菌落总数

解析：本题考查判断水质是否达到流行病学上安全的重要指标。自然灾害发生后，判断水质是否达到流行病学上安全的重要指标有总大肠菌群、菌落总数（D对ABCE错）、耐热大肠菌群、大肠埃希菌。